1.5岁男孩。发热，咳嗽1周，气促。精神正常，食欲尚可，无明显异物史。查体：体温37.8℃，双肺呼吸音粗糙及有不固定的干湿啰音。胸部X线显示肺纹理增粗。诊断最大的可能是
A. 支气管异物
B. 肺结核
C. 急性支气管炎
D. 支气管哮喘
E. 哮喘性支气管炎

正确答案：C。急性支气管炎

解析：患者急性起病，咳嗽、低热、气促，无明显异物史可排除支气管异物（A错）；无反复发作的喘息、未提及过敏史，排除支气管哮喘（D错）；胸片未见结节或肺门淋巴结肿大，排除肺结核（B错）。双肺可闻及粗糙不固定的干湿啰音，为急性支气管炎多的典型体征，结合胸片示肺纹理增粗，进一步提示感染，考虑诊断急性支气管炎（C对）。